心理咨询的对象大多数是
A. 精神病人
B. 躯体疾病患者
C. 心理异常的病人
D. 人格障碍者
E. 心理困难的正常人

正确答案：E。心理困难的正常人